桂枝多用于治疗
A. 有汗骨蒸
B. 阳明头痛
C. 无汗骨蒸
D. 外感风寒表虚有汗
E. 邪在少阳，寒热往来

正确答案：D。外感风寒表虚有汗

解析：桂枝辛甘温煦，甘温通阳扶卫，其开腠发汗之力较麻黄温和，而善于宣阳气于卫分，畅营血于肌表，故有助卫实表，发汗解肌，外散风寒之功。对于外感风寒，不论表实无汗、表虚有汗及阳虚受寒者，均宜使用（D对）。牡丹皮功效清热凉血，活血化瘀，性味苦辛寒，入血分而善于清透阴分伏热，为治无汗骨蒸（C错）之要药。地骨皮功效凉血除蒸，清肺降火，甘寒清润，入肝、肾经，善于清虚热、除骨蒸，为凉血退热，治疗有汗骨蒸（A错）之佳品。阳明头痛（B错）用白芷、升麻。柴胡微寒退热，善于祛邪解表退热和疏散少阳半表半里之邪，适用于伤寒邪在少阳，寒热往来（E错）、胸胁苦满、口苦咽干、目眩之证。